《学校卫生条例》规定，下列哪个机构对学校卫生监督工作行使职权
A. 县级以上卫生行政部门
B. 县级以上卫生专业机构
C. 县级以上教育行政部门
D. 省级以上教育行政部门
E. 省级以上卫生专业机构

正确答案：A。县级以上卫生行政部门